不属于预防性消毒的方法是
A. 饮水加氯消毒
B. 食具煮沸消毒
C. 剧场空气消毒
D. 生活用水消毒
E. 对痢疾患者每次所排粪便进行消毒

正确答案：E。对痢疾患者每次所排粪便进行消毒

解析：本题考查预防性消毒的方法。预防性消毒是指在没有发现明确传染源的情况下，对可能被传染病病原体污染的场所和物品进行消毒。如饮水加氯消毒（A对）、食具煮沸消毒（B对）、剧场空气消毒（C对）、生活用水消毒（D对）等。对痢疾患者每次所排粪便进行消毒（E错，为本题正确答案）属于疫源地消毒中的随时消毒。